对于深Ⅱ度烧伤的描述正确的是
A. 一般不留瘢痕
B. 创面红润、潮湿
C. 如无感染，1～2周愈合
D. 深度为表皮的生发层
E. 痛觉较迟钝

正确答案：E。痛觉较迟钝

解析：本题考查深Ⅱ度烧伤。对于深Ⅱ度烧伤的描述正确的是痛觉较迟钝（E对）。深Ⅱ度烧伤伤及真皮乳头层以下，但仍残留部分网状层，深浅不尽一致，也可有水疱，但去疱皮后，创面微湿，红白相间（B错），痛觉较迟钝；由于真皮层内有残存的皮肤附件，创面修复可赖其上皮增殖形成上皮小岛，如不感染，可融合修复，需时3～ 4周（C错）；但常有瘢痕增生（A错）。烧伤深度为表皮的生发层（D错），创面红润、潮湿（B错）见于浅Ⅱ度烧伤。